患者，女，60岁，初戴全口义齿，医师检查发现在正中（牙合）接触时，咬合接触点少，侧方（牙合）时工作侧有接触，平衡侧也有接触，应调磨的位置是
A. 工作侧上后牙舌尖和下后牙颊尖
B. 工作侧上后牙颊尖颊斜面和下后牙颊尖舌斜面
C. 工作侧上后牙颊尖舌斜面和下后牙颊尖颊斜面
D. 工作侧上后牙舌尖舌斜面和下后牙舌尖颊斜面
E. 工作侧上后牙舌尖颊斜面和下后牙颊尖颊斜面

正确答案：A。工作侧上后牙舌尖和下后牙颊尖

解析：本题考查全口义齿初戴。题干中正中（牙合）有早接触，此处侧方（牙合）工作侧也有早接触，所以在正中（牙合）和侧方（牙合）都有早接触的情况下，应调磨功能尖，即上后牙的舌尖和下后牙的颊尖（A对）。如果正中（牙合）有早接触的支持尖在作为平衡侧时也存在（牙合）干扰，则调磨支持尖。如果作为平衡侧时无（牙合）干扰，则调磨与支持尖相对的对（牙合）牙的中央窝或（牙合）边缘嵴。